可降低血糖水平的食物或食物成分是
A. 膳食纤维
B. 高GI食物
C. 支链淀粉
D. 低聚异麦芽糖
E. 果糖

正确答案：A。膳食纤维

解析：本题考查可降低血糖水平的食物或食物成分。膳食纤维（A对）有降低空腹血糖和延缓碳水化合物吸收、降低餐后血糖及改善葡萄糖耐量的作用。高GI食物（B错）不利于餐后血糖的控制，可使血糖升高。支链淀粉（C错）更易引起血糖和胰岛素水平快速明显升高。低聚异麦芽糖（D错）的热能低，在小肠内不被吸收，因此长期食用既不增加血糖，也不改变血中胰岛素水平。果糖（E错）更易于人体吸收和利用，既能够影响胰岛素结合，又能够影响胰岛素刺激的糖转运。